男，50岁。干农活时刺伤右足10天，当时未就医，伤口已愈合良好，伤口内无异物残留。感张口困难2天，颈项紧，饮水可诱发手足痉挛，病情逐渐加重，抽搐频繁，用药物未控制，呼吸道分泌物较多，有窒息的危险，为保持呼吸道的通畅，最有效的措施是
A. 协助拍背咳痰咳液
B. 环甲膜穿刺
C. 气管插管
D. 气管切开
E. 吸痰、吸氧

正确答案：D。气管切开

解析：中年患者，干农活时刺伤右足未进行清创处理，感张口困难2天，颈项紧（破伤风感染的典型临床表现），饮水可诱发手足痉挛，病情逐渐加重，抽搐频繁，考虑诊断为破伤风感染，现有窒息的危险，为保持呼吸道的通畅，最有效的措施是气管切开（D对），以便改善通气，清除呼吸道分泌物。